邪气亢盛，结聚于内，阻滞经络，气血不能外达所形成的病机是
A. 真实假虚
B. 由实转虚
C. 实中夹虚
D. 真虚假实
E. 因虚致实

正确答案：A。真实假虚

解析：邪气亢盛，结聚于内，阻滞经络，表明有实邪，本质为邪实，气血不能外达，表现为虚，表面假象为虚（A对）。在疾病发展过程中，邪正双方的力量对比经常发生着变化，当邪正双方力量的消长变化达到主要与次要矛盾方面互易其位的程度时，则疾病的虚实性质亦会发生转变，呈现由实转虚（B错）或因虚致实的变化（E错）。实中夹虚是指实证为主，兼夹虚证（C错）。因体质虚弱，脏腑精气功能减退而出现闭塞症状的真虚假实证（D错）。